肉苁蓉饮片切面可见
A. 淡棕色或棕黄色点状维管束，排列成波状环纹
B. 棕色与白色组织相间，排列成大理石样花纹
C. 黄白色维管束小点，排列成环状
D. 棕色形成层环，近方形或近圆形
E. 黄白色维管束，排列成双卷状

正确答案：A。淡棕色或棕黄色点状维管束，排列成波状环纹

解析：本题考查的是肉苁蓉饮片的鉴别。肉苁蓉饮片切面可见淡棕色或棕黄色点状维管束，排列成波状环纹（A对）。肉苁蓉：【性状鉴别】饮片呈不规则形的厚片。表面棕褐色或灰棕色，有的可见肉质鳞叶。切面有淡棕色或棕黄色点状维管束，排列成波状环纹。气微，味甜、微苦。棕色与白色组织相间，排列成大理石样花纹（B错）为槟榔饮片切面的鉴别特点。槟榔：【性状鉴别】饮片呈类圆形的薄片。切面可见棕色种皮与白色胚乳相间的大理石样花纹。气微，味微涩、微苦。黄白色维管束小点，排列成环状（C错）为绵马贯众饮片切面的鉴别特点。绵马贯众：【性状鉴别】饮片呈不规则厚片或碎块，根茎外表面黄棕色至黑褐色，多被有叶柄残基，有的可见棕色鳞片，切面淡棕色至红棕色，有黄白色维管束小点，环状排列。气特异，味初淡而微涩，后渐苦、辛。棕色形成层环，近方形或近圆形（D错）为白芷饮片切面的鉴别特点。白芷：【性状鉴别】饮片为类圆形的厚片。外表皮灰棕色或黄棕色。切面白色或灰白色，显粉性，形成层环棕色，近方形或近圆形，皮部散有多数棕色油点。气芳香，味辛、微苦。黄白色维管束，排列成双卷状（E错），2022年考试指南未明确说明。